2017年初，某医院召开药事管理与药物治疗学委员会会议和抗菌药物管理工作组审议会议。会议通报了医院合理用药情况，拟定了2017年全院抗菌药物专项整治工作方案，并对院内抗菌药物品种遴选、采购、清退、更换等事宜进行表决。根据《抗菌药物临床应用管理办法》，该医院遴选和新引进抗菌药物品种的程序要求是
A. 临床科室提交申请报告，药学部门提出意见，经抗菌药物管理组全体成员审议同意
B. 临床科室提交申请报告，经抗菌药物管理组三分之二以上成员审议同意
C. 临床科室提交申请报告，药学部门提出意见，经药事管理与药物治疗学委员二分之一以上审核同意
D. 临床科室提交申请报告，药学部门提出意见，经抗菌药物管理组三分之二以上成员审议同意，并须经药事管理与药物治疗学委员三分之二以上审核同意

正确答案：D。临床科室提交申请报告，药学部门提出意见，经抗菌药物管理组三分之二以上成员审议同意，并须经药事管理与药物治疗学委员三分之二以上审核同意

解析：本题考查的是抗菌药物遴选和定期评估制度。2017年初，某医院召开药事管理与药物治疗学委员会会议和抗菌药物管理工作组审议会议。会议通报了医院合理用药情况，拟定了2017年全院抗菌药物专项整治工作方案，并对院内抗菌药物品种遴选、采购、清退、更换等事宜进行表决。根据《抗菌药物临床应用管理办法》，该医院遴选和新引进抗菌药物品种的程序要求是临床科室提交申请报告，药学部门提出意见，经抗菌药物管理组三分之二以上成员审议同意，并须经药事管理与药物治疗学委员三分之二以上审核同意（D对）。抗菌药物遴选和定期评估制度：医疗机构遴选和新引进抗菌药物品种，应当由临床科室提交申请报告，经药学部门提出意见后，由抗菌药物管理工作组审议。抗菌药物管理工作组三分之二以上成员审议同意，并经药事管理与药物治疗学委员会三分之二以上委员审核同意后方可列入采购供应目录。抗菌药物品种或者品规存在安全隐患、疗效不确定、耐药率高、性价比差或者违规使用等情况的，临床科室、药学部门、抗菌药物管理工作组可以提出清退或者更换意见。清退意见经抗菌药物管理工作组二分之一以上成员同意后执行，并报药事管理与药物治疗学委员会备案，更换意见经药事管理与药物治疗学委员会讨论通过后执行。清退或者更换的抗菌药物品种或者品规原则上12个月内不得重新进入本医疗机构抗菌药物供应目录。